血友病实验室检查结果不正确的是
A. APTT延长
B. PT正常
C. BT延长
D. 凝血因子活性减低
E. 凝血因子抗原含量减低

正确答案：C。BT延长

解析：本题考查血友病。血友病实验室检查结果不正确的是BT延长（C错，为本题正确答案）。相关实验室检查包括：①筛选试验：凝血时间（CT）正常或延长，激活部分凝血活酶时间（APTT）延长（A对），而凝血酶原时间（PT）正常（B对），应考虑血友病可能；②确诊试验：凝血因子Ⅷ、C、凝血因子Ⅸ、凝血因子Ⅺ抗原及活性测定，凝血因子活性减低（D对），凝血因子抗原含量减低（E对）。